与溶解在水中的氧含量有关的因素有
A. 空气氧分压
B. 水pH
C. 水中微生物数量
D. 水体浑浊度
E. 水体的有机物污染状况

正确答案：A。空气氧分压

解析：本题考查溶解氧的相关内容。溶解氧指溶解在水中的氧含量。其含量与空气中的氧分压（A对BCDE错）、水温有关。一般而言，同一地区空气中的氧分压变化甚微，故水温是主要的影响因素，水温愈低，水中溶解氧含量愈高。